社会医学的基本任务是
A. 弘扬正确的医学模式
B. 倡导积极的健康观
C. 发现社会卫生问题
D. 开展特殊人群的预防保健工作
E. 以上都是

正确答案：E。以上都是